完全随机设计资料多个样本均数的比较时，若处理无作用，则方差分析的F值在理论上应等于
A. -1
B. 0
C. 1
D. ∞
E. 任意值

正确答案：C。1